男，8岁。右足底被铁锈钉刺伤12天，出现张口困难，继之出现苦笑面容，角弓反张，声响及触碰病人可诱发上述症状，神志清楚，无发热。对病人威胁极大的是
A. 肌肉断裂
B. 骨折
C. 尿潴留
D. 营养障碍
E. 持续的呼吸肌痉挛

正确答案：E。持续的呼吸肌痉挛

解析：患者右足底被铁锈钉刺伤（深部创伤），后出现张口困难，苦笑面容，角弓反张，声响及触碰病人可诱发上述症状，应诊断为破伤风（破伤风是是常和创伤相关联的一种特异型感染。其典型表现为张口困难、哭笑面容、角弓反张等肌肉痉挛症状，可因轻微的刺激，如光、声、接触、饮水等诱发）。病人感染破伤风梭菌后，病原体可迅速释放大量痉挛毒素，使患者发生强烈的肌痉挛。强烈的肌肉痉挛可产生肌断裂（A错）、骨折（B错）、尿潴留（C错）、呼吸骤停等严重临床危重症。但病人死亡原因多为呼吸肌痉挛所致的窒息，所以对病人最大的威胁是持续的呼吸肌痉挛（E对）。破伤风感染患者由于不断阵发痉挛，出大汗等，故每日消耗热量和水分丢失较多，易发生营养障碍（D错），但多较轻。